含生物碱的常见科属有
A. 毛茛科
B. 防己科
C. 伞形科
D. 五加科
E. 茄科

正确答案：A、B、C、D、E。毛茛科；防己科；伞形科；五加科；茄科